在帕金森病中有遗传基因异常的家族性帕金森病约占
A. 0.05
B. 0.1
C. 0.25
D. 0.35
E. 0.45

正确答案：B。0.1